人体器官系统在由胎儿期发育至成熟的过程中，以下哪一个系统仅存在一次生长突增高峰
A. 骨骼系统
B. 肌肉系统
C. 神经系统
D. 呼吸系统
E. 循环系统

正确答案：C。神经系统